外展内收型肱骨外科颈骨折的复位方法是
A. 手法复位小夹板固定
B. 三角巾悬吊
C. 单纯手法复位
D. 保守治疗
E. 切开复位

正确答案：A。手法复位小夹板固定

解析：七版外科学P746将肱骨外科颈骨折分为无移位型、外展型、内收型和粉碎型骨折。外展型和内收型骨折均主要采用手法复位、小夹板外固定方法治疗（A对）。三角巾悬吊（B错）用于无移位型骨折。由于外展型和内收型骨折均有移位，因此复位后都应进行固定处理（C错）。切开复位（E错）适用于粉碎性骨折、手法复位失败、陈旧骨折不愈合等。